荆芥的主治病证有
A. 风热表证
B. 风寒表证
C. 风疹瘙痒
D. 疮疡初起兼表者
E. 崩漏便血

正确答案：A、B、C、D、E。风热表证；风寒表证；风疹瘙痒；疮疡初起兼表者；崩漏便血

解析：本题考查荆芥的主治病证。荆芥的主治病证有风热表证（A对）、风寒表证（B对）、风疹瘙痒（C对）、疮疡初起兼表者（D对）、崩漏便血（E对）。荆芥【主治病证】（1）风寒表证，风热表证。（2）麻疹透发不畅，风疹瘙痒。（3）疮疡初起有表证者。（4）（荆芥炭）衄血，吐血，便血，崩漏等证。